对乙酰氨基酚片应检查的杂质是
A. 对氨基苯甲酸
B. 游离水杨酸
C. 莨菪碱
D. 对氨基酚
E. 5-羟甲基糖醛

正确答案：D。对氨基酚

解析：本题考查对乙酰氨基酚杂质的检查。对乙酰氨基酚中的特殊杂质为对氨基酚（D对）及有关物质。